女童，7岁，乳牙龋坏较多，六龄牙完全萌出，窝沟较深，无明显龋坏，要求预防，该患者首选的龋病预防措施是六龄牙的窝沟封闭。若使用没有填料的封闭剂，则下列操作过程中不正确的是
A. 注意隔湿
B. 恒牙酸蚀半分钟
C. 酸蚀后加压冲洗15秒
D. 用不含氟的清洁剂清洁牙面
E. 封闭后需调（牙合）

正确答案：E。封闭后需调（牙合）

解析：本题考查窝沟封闭术。六龄牙的窝沟封闭，若使用没有填料的封闭剂，操作过程中不正确的是封闭后需调（牙合）（E错，为本题正确答案）。若封闭剂没有填料则不需要调（牙合），若封闭剂有填料则需要调（牙合）。窝沟封闭的操作步骤：1.用不含氟的清洁剂清洁牙面（D对）后即用棉纱球隔湿（A对）。2.将牙面吹干后用细毛刷、小棉球或小海绵块蘸上酸蚀剂放在要封闭的牙面上。酸蚀剂可为磷酸液或含磷酸的凝胶，酸蚀面积应为接受封闭的范围，一般为牙尖斜面的2/3。恒牙酸蚀的时间一般为20～30秒（B对），乳牙酸蚀60秒。注意酸蚀过程中不要擦拭酸蚀牙面，因为这会破坏被酸蚀的牙釉面，降低黏结力。放置酸蚀剂时要注意酸的用量适当，不要溢出到口腔软组织，还要注意避免产生气泡。3.冲洗和干燥，彻底加压冲洗牙面15秒（C对），吹干牙面约15秒，干燥后牙面呈白色雾状。4.涂布封闭剂，将封闭剂直接涂在已酸蚀的牙面上，注意使封闭剂渗入窝沟，使窝沟内的空气排出，放置适量的封闭剂以覆盖合面全部酸蚀面。5.固化，用可见光源照射20～40秒，固化封闭剂，照射部位要大于封闭剂涂布的部位。6.检查，用探针进行全面检查，了解固化程度，粘接情况。窝沟封闭后应定期复查。